临床术前准备的道德要求不包括
A. 严密观察、提前处理
B. 认真操作、一丝不苟
C. 手术过程告知患者进展情况
D. 以主刀医生为主导，协作人员不得发表意见
E. 麻醉医生只须做好麻醉工作，术中不得与手术人员交谈

正确答案：E。麻醉医生只须做好麻醉工作，术中不得与手术人员交谈